下列各项，不属全国突发事件应急预案内容的是
A. 突发事件应急处理技术和监测机构及其任务
B. 突发事件应急处理专业队伍的建设和培训
C. 突发事件信息的收集，分析，报告，通报制度
D. 突发事件的立法规划方案
E. 突发事件的分级和应急处理工作方案

正确答案：D。突发事件的立法规划方案

解析：突发事件的立法规划方案，不属全国突发事件应急预案的内容（D错，为本题正确答案）。